女，28岁，X线片：牙槽骨破坏以上下左右6及左右下12重，但其他牙齿的牙槽骨也出现破坏，程度不一。请问此患者的最可能的诊断为
A. 慢性牙周炎
B. 快速进展型牙周炎
C. 青少年牙周炎
D. 急性坏死性龈炎
E. 多发性牙周脓肿

正确答案：B。快速进展型牙周炎

解析：本题考查侵袭性牙周炎。根据病例描述，患者女性28岁，牙槽骨破坏以上下左右6及左右下12重，但其他牙齿的牙槽骨也出现破坏，程度不一，可知患者牙周损坏弥漫，累及多数牙，牙槽骨破坏以及上下左右6及左右下12重，可考虑患者曾有青少年牙周炎病史，因此，最可能的诊断为快速进展型牙周炎（B对）。青少年牙周炎（C错）主要发生在青春期至25岁的年轻人，其典型的好发部位为上下切牙和第一恒磨牙，患者28岁，虽然牙槽骨破坏以上下左右6及左右下12重，但其他牙齿的牙槽骨也出现破坏，程度不一，因此考虑患者目前诊断为快速进展型牙周炎，但患者曾有青少年牙周炎病史。慢性牙周炎（A错）主要由菌斑牙石长期刺激所致，病程进展缓慢，多发生于35岁左右，且没有典型的上下切牙和第一恒磨牙破坏严重的表现，故不考虑此诊断。急性坏死性龈炎（D错）起病急，病程短，牙龈自动出血，腐败性口臭，牙龈乳头消失呈刀切状，下前牙龈缘虫蚀状坏死，有假膜覆盖，且多伴有全身症状，一般不会有牙槽骨的吸收，故不考虑此诊断。多发性牙周脓肿（E错）为牙周炎晚期的伴发病变，主要表现为患牙的唇颊侧或舌腭侧牙龈形成半球形或椭圆形的肿胀突起，牙龈红肿，伴有全身不适症状，病例中未提及全身症状，故不考虑此诊断。